肾结核伴脊柱活动受限
A. 非手术抗结核治疗
B. 积水肾造瘘术
C. 抗结核治疗后双肾移植
D. 肾大部切除术后抗结核治疗
E. 脊柱矫形术

正确答案：A。非手术抗结核治疗

解析：肾结核伴有脊柱活动受限，提示结核分枝杆菌已侵入脊柱，可能继发有脊柱结核，故此时应先非手术抗结核治疗（A对），待病情控制后再行进一步治疗。